下列哪种属于自然被动免疫
A. 注射丙种球蛋白
B. 注射抗毒素血清
C. 从母体经胎盘得到的抗体
D. 接种类毒素产生的抗体
E. 接种疫苗产生的抗体

正确答案：C。从母体经胎盘得到的抗体

解析：注射与接种的均为人工免疫的方法，而胎儿时期从母体胎盘中得到的抗体属于自然被动免疫的类别。掌握“免疫预防及免疫治疗”知识点。